易复发可恶变的颌骨病变是
A. 根端囊肿
B. 始基囊肿
C. 含牙囊肿
D. 角化囊性瘤
E. 外渗性囊肿

正确答案：D。角化囊性瘤

解析：易复发可恶变的颌骨肿瘤是牙源性角化囊性瘤。角化囊性瘤可以癌变，条件为：40岁以上；有反复感染史；均为多囊性；病理呈典型鳞癌变；以及增殖细胞核抗原（PCNA）表达显著增强。掌握“牙源性颌骨囊肿”知识点。